二氢吡啶环上，2，6位取代基不同的药物是
A. 氨氯地平
B. 尼卡地平
C. 硝苯地平
D. 尼群地平
E. 尼莫地平

正确答案：A。氨氯地平

解析：本题考查氨氯地平的结构。氨氯地平（A对）2位为2-氨乙氧甲基，6位为甲基。尼卡地平（B错）、硝苯地平（C错）\尼群地平（D错）和尼莫地平（E错）2，6位均为甲基。